某妇女，28岁，平时月经规律，26～28天一次，每次持续4天，其月经第一天是10月1日，今天是10月3日，那么，她的子宫内膜变化处于
A. 月经期
B. 增生期
C. 分泌期
D. 月经前期
E. 初潮期

正确答案：A。月经期

解析：月经期：月经周期第1～4日。掌握“女性生殖系统生理”知识点。